是一种天然的抗菌药，对酸不稳定，不可口服的是
A. 磺胺嘧啶
B. 头孢氨苄
C. 甲氧苄啶
D. 青霉素钠
E. 氯霉素

正确答案：D。青霉素钠

解析：本题考查β-内酰胺类抗菌药物。青霉素钠（D对）是天然的抗菌药，对酸不稳定，不可口服。磺胺嘧啶（A错）具广谱的抑菌活性,有较强酸性。头孢氨苄（B错）为半合成头孢菌素药，具有较强的抗菌活性。甲氧苄啶（C错）为广谱抗菌药，有抑制二氢叶酸还原酶的作用。氯霉素（E错）主要通过抑制细菌蛋白质的合成,起到抑制细菌的作用。